妊娠腹痛血虚证的治法是
A. 疏肝解郁，养血安胎
B. 暖宫止痛，养血安胎
C. 养血安胎止痛
D. 养血活血，补肾安胎
E. 温经散寒，养血安胎

正确答案：C。养血安胎止痛

解析：妊娠腹痛血虚证是由于素体血虚或脾虚化源不足，妊娠后血聚子宫以养胎，阴血益虚，胞脉失养致小腹疼痛，若血虚气弱，血少乏于畅行，气虚无力帅血，胞脉滞迟作痛，治法养血安胎止痛（C对）。妊娠腹痛气滞证的治法疏肝解郁，养血安胎（A错）。妊娠腹痛虚寒证的治法暖宫止痛，养血安胎（B错）。妊娠腹痛血瘀证的治法养血活血，补肾安胎（D错）。妊娠腹痛虚寒证的治法暖宫止痛，养血安胎（E错）。